右心感染性心内膜炎最常见的栓塞部位是
A. 冠状动脉
B. 肺动脉
C. 肾动脉
D. 大脑中动脉
E. 下肢动脉

正确答案：B。肺动脉

解析：右心感染性心内膜炎所产生的栓子常随血流进入肺动脉（B对）的主干及其分支，引起肺栓塞。肾动脉（C错）、大脑中动脉（D错）及下肢动脉（E错）常为主动脉系统及左心室的栓子的栓塞部位。